小儿体格发育的两个高峰期是
A. 青春期、学龄期
B. 学龄期、学龄前期
C. 青春期、幼儿期
D. 青春期、婴儿期
E. 学龄期、新生儿期

正确答案：D。青春期、婴儿期

解析：第1年内婴儿前3个月体重的增加值约等于后9个月内体重的增加值，即12月龄时婴儿体重约为出生时的3倍（10kg），是生后体重增长最快的时期，系第一个生长高峰；青春期是儿童到成人的过渡期，受激素等因素的影响，体格生长出现生后的第二个高峰（peak height velocity，PHV），有明显的性别差异。所以小儿体格发育的两个高峰期是婴儿期和青春期（D对）。